X线片检查患牙根管充填不良，能够提高根管治疗质量的方案应首选
A. 全冠修复
B. 根尖诱导成形术
C. 正畸治疗
D. 根尖手术
E. 根管再治疗

正确答案：E。根管再治疗

解析：X线片检查患牙根管充填不良，经评估通过根管再治疗能够提高根管治疗的质量，该类病例应首选根管再治疗。掌握“根管再治疗”知识点。